一正常小儿身高80cm，前囟已闭，头围47cm，乳牙16枚，能用简单的语言表达自己的需要，对人、事有喜乐之分。此小儿的年龄最可能是
A. 1岁
B. 1岁半
C. 2岁半
D. 3岁
E. 3岁半

正确答案：B。1岁半

解析：一正常小儿身高80cm，表明该小儿年龄介于1～2岁之间；前囟已闭，表明该小儿年龄在2岁之前；头围47cm，表明该小儿年龄介于1～2岁之间；乳牙16枚，表明该小儿年龄不大于3岁；能用简单的语言表达自己的需要，对人、事有喜乐之分，表明该小儿年龄在2岁左右，故此小儿的年龄最可能是1岁半（B对）。